结构属于异环双烯类的皂苷是
A. 柴胡皂苷a
B. 柴胡皂苷b₁
C. 柴胡皂苷c
D. 柴胡皂苷g
E. 柴胡皂苷d

正确答案：B。柴胡皂苷b₁

解析：本题考查的是柴胡皂苷元的结构类型。结构属于异环双烯类的皂苷是柴胡皂苷b₁（B对）。柴胡皂苷元的结构类型：属于Ⅰ型的皂苷，其结构中具有13β、28-环氧醚键，是柴胡中的原生苷，如柴胡皂苷a、c、d、e（ACE错）等。Ⅱ型柴胡皂苷为异环双烯类，如柴胡皂苷b₁、b₂等；Ⅲ型为Δ¹²齐墩果烷衍生物，并且大多在C-11位有α-OCH₃取代。这两种类型的柴胡皂苷大多为次生苷，是因为在提取过程中植物体内所含酸性成分的影响，使Ⅰ型皂苷结构中的环氧醚键开裂而产生的，如柴胡皂苷b₃、b₄等。Ⅳ型具有同环双烯结构，也被认为是原生苷的环氧醚键开裂，同时发生双键转移而产生的，如柴胡皂苷g（D错）。Ⅴ型为齐墩果酸衍生物。Ⅳ、Ⅴ型数量较少。